医患之间正常的信托关系应该建立于哪一种关系之上
A. 上下级关系
B. 契约关系
C. 社会主义医德关系和法制关系
D. 亲属关系
E. 货币交易关系

正确答案：B。契约关系

解析：从法律上来说，医患关系是一种医疗契约关系。掌握“医患关系伦理”知识点。